职业病诊断证明书应当由
A. 接诊医师签署
B. 主治医师签署
C. 主任医师签署
D. 医院的法人签署
E. 参加诊断的医师共同签署

正确答案：E。参加诊断的医师共同签署